最初的下颌骨骨化中心为胚胎
A. 第四周
B. 第五周
C. 第六周
D. 第七周
E. 第八周

正确答案：D。第七周

解析：胚胎第七周时，细胞凝聚区分化出成骨细胞、出现骨膜内骨化，形成最初的下颌骨骨化中心。掌握“唾液腺与颌骨的发育”知识点。